阳盛格阴的证候是
A. 真热假寒证
B. 阴虚内热证
C. 真寒假热证
D. 阳虚内寒证
E. 寒热错杂

正确答案：A。真热假寒证

解析：阳盛格阴的证候是内真热外假寒证（A对）。阴偏衰表现为虚热证（B错）。阴盛格阳表现为真寒假热证（C错）。阳偏衰表现为阳虚内寒证（D错）。寒热错杂是指阴阳不相顺接，口渴不饮，气上冲心，胸中疼热，饥不欲食，食则呕吐或吐蛔，厥逆不利（E错）。